医务人员应当保守的医疗秘密是
A. 患者的病情
B. 患者的性别
C. 医务人员的家庭住址
D. 患者的医疗方案
E. 医院及医务人员的特色、特长

正确答案：A。患者的病情

解析：医务人员应当保守的医疗秘密是患者的病情（A对）。保守医密的一般要求有两个方面：一是保守病人的秘密；二是对病人保守秘密，包括不良诊断、进展、预后及在给病人治疗过程中出现的一些问题，以避免不良信息影响病人的心理状态，进而影响救治，给病人带来伤害。